急性肾衰时出现心率缓慢心律不齐心室纤颤停搏时与下列哪种因素有关
A. 酸中毒
B. 水钠储溜
C. 肺水肿
D. 高钾血症
E. 低钾血症

正确答案：D。高钾血症

解析：急性肾衰竭的患者肾功能的下降，会导致体内的很多毒素不能排出，钾虽然不是毒素，但是作为一种离子，在肾衰竭的情况下不能通过肾脏的透明膜，只能在血液系统里面不停地循环，不能够通过尿液排出去，这就是肾衰竭导致高钾血症的最主要的原因；急性肾衰竭本身容易合并酸中毒等酸碱失衡的情况，而酸中毒容易导致细胞内的钾离子释放到细胞外，进一步加重高钾血症，因此会出现心率缓慢、心律不齐、心室纤颤停搏（D对）；急性肾衰会导致代谢性酸中毒，代谢性酸中毒对心率的影响呈双向性。严重酸中毒可以伴随心律失常，心动过速或过缓（A错）；水钠储溜会导致血压升高，此外，肾脏如长期处于高灌流压的状态下，会发生结构上的改变，造成肾血管变性、管腔变窄甚至闭塞，导致肾实质缺血，肾小球纤维化，肾小管萎缩，直至肾功能衰竭（B错）；急性肾衰会导致急性肺水肿，症状表现为严重的呼吸困难、咳嗽、烦躁不安、口唇紫绀等（C错）；急性肾衰会导致低钾血症，循环系统症状可出现心动过速（窦性、房性、室性）、期前收缩等各种心律失常。严重者可出现心室颤动、心室扑动等（E错）。